因可抑制患儿的生长和发育，小儿应避免使用的长效糖皮质激素是
A. 地塞米松
B. 可的松
C. 泼尼松
D. 泼尼松龙
E. 氢化可的松

正确答案：A。地塞米松

解析：本题考查地塞米松。因可抑制患儿的生长和发育，小儿应避免使用的长效糖皮质激素是地塞米松（A对）。小儿如使用肾上腺皮质激素，须十分慎重，用激素可抑制患儿的生长和发育，如确有必要长期使用时，应使用短效或中效制剂，避免使用长效地塞米松制剂。可的松（B错）和氢化可的松（E错）为短效制剂。泼尼松（C错）和泼尼松龙（D错）为中效制剂。